用于慢性哮喘症状控制的N-羟基脲类5-脂氧合酶抑制剂的是
A. 曲尼司特
B. 氨茶碱
C. 扎鲁司特
D. 二羟丙茶碱
E. 齐留通

正确答案：E。齐留通

解析：本题考查齐留通。齐留通（E对）是用于慢性哮喘症状的控制的N-羟基脲类5-脂氧合酶抑制剂。氨茶碱（B错）、二羟丙茶碱（D错）是磷酸二脂酶抑制剂；曲尼司特（A错）是过敏介质阻滞剂；扎鲁司特（C错）是选择性的白三烯受体拮抗剂。